国家药品监督管理局药品审评中心在审评药品制剂注册申请时，对药品制剂选用的化学原料药，辅料及直接接触药品的包装材料和容器纳入
A. 关联审评审批程序
B. 简化审批程序
C. 附条件批准程序
D. 突破性治疗药物程序

正确答案：A。关联审评审批程序

解析：本题考查药品审评审批的基本程序和要求。国家药品监督管理局药品审评中心在审评药品制剂注册申请时，对药品制剂选用的化学原料药，辅料及直接接触药品的包装材料和容器纳入关联审评审批程序（A对）。国家药品监督管理局建立化学原料药、辅料及直接接触药品的包装材料和容器（以下简称原辅包）关联审评审批制度，在审批药品制剂时，对化学原料药一并审评审批，对相关辅料、直接接触药品的包装材料和容器一并审评。附条件批准程序（C错）药物临床试验期间，符合以下情形的药品，可以申请附条件批准：①治疗严重危及生命且尚无有效治疗手段的疾病的药品，药物临床试验已有数据证实疗效并能预测其临床价值的；②公共卫生方面急需的药品，药物临床试验已有数据显示疗效并能预测其临床价值的；③应对重大突发公共卫生事件急需的疫苗或者国家卫生健康委员会认定急需的其他疫苗，经评估获益大于风险的。药物临床试验期间，用于防治严重危及生命或者严重影响生存质量的疾病，且尚无有效防治手段或者与现有治疗手段相比有足够证据表明具有明显临床优势的创新药或者改良型新药等，申请人可以申请适用突破性治疗药物程序（D错）。